各种微生物因其不同的生物特性而对氯化消毒的耐受程度不同，一般规律是
A. 细菌对氯化消毒的耐受力强于病毒
B. 细菌对氯化消毒的耐受力弱于病毒
C. 腺病毒的耐受力较一般病毒更强
D. 原生生物对氯化消毒的耐受性最强
E. 以上都不是

正确答案：B。细菌对氯化消毒的耐受力弱于病毒

解析：本题考查微生物对氯化消毒的耐受程度。各种微生物因其不同的生物特性而对氯化消毒的耐受程度不同，一般规律是细菌对氯化消毒的耐受力弱于病毒（B对ACDE错）。